下列除哪项外，均是婴儿添加辅食的原则
A. 由荤食到素食
B. 由稀薄到稠厚
C. 由少量到多量
D. 由一种到多种
E. 各种喂养方式均应按时添加辅食

正确答案：A。由荤食到素食

解析：婴儿期生长发育特别快，脾胃常显不足，合理喂养显得特别重要，所添加食物顺序应与婴儿的脾胃运化能力相适应，应从素食至荤食，不然易致婴儿积食，腹痛，腹泻等（A错为本题正确答案）。从稀到稠，从少到多，由一种到多种，都与婴儿逐渐增长的消化功能相适应（BCD对）。在婴儿期无论哪种喂养方式均应按时添加辅食以保证婴儿的营养供给及消化能力的增长（E对）。